不属于神经衰弱常见症状的是
A. 易兴奋、易疲劳
B. 意志减退
C. 紧张性头痛
D. 情感脆弱
E. 缺乏睡眠感

正确答案：B。意志减退

解析：意志减退多见于抑郁发作和精神分裂症（B错，为本题正确答案），不属于神经衰弱常见症状。神经衰弱常表现①精神易兴奋和脑力易疲乏（A对）；②紧张性疼痛（C对）；③情感脆弱（D对）；④睡眠紊乱：缺乏睡眠感（E对）；⑤易激惹；⑥肌肉疼痛感（B错，为本题正确答案）。